可以满足某一特定性别，年龄及生理状况群体中绝大多数个体（97%～98%）需要量的某种营养素的摄入水平是
A. 适宜摄入量（AI）
B. 平均需要量（EAR）
C. 推荐摄入量（RNI）
D. 参考摄入量（DRIs）
E. 可耐受最高摄入量（UL）

正确答案：C。推荐摄入量（RNI）

解析：推荐摄入量（RNI）是指可以满足某一特定性另、年龄及生理状况群体中绝大多数（97%～98%）个体的需要（C对）。适宜摄入量（AI）的是指健康人群某种营养素的摄入量。平均需要量（EAR）是指是某一特定性别、年龄及生理状况群体中对某营养素需要量的平均值，摄入量达到EAR水平时可以满足群体中50%个体的需要。参考摄入量（DRIs）包括四个方面，分别是该题的其他4个选项。可耐受最高摄入量（UL）是指是平均每日可以摄入该营养素的最高量。由此可知适宜摄入量（AI）（A错）、平均需要量（EAR）（B错）、参考摄入量（DRIs）（D错）、可耐受最高摄入量（UL）（E错）的概念与题干不符。